男，45岁。酗酒后8小时出现中上腹疼痛，放射至两侧腰部，伴恶心、呕吐。体检：腹部有压痛、肌紧张及两侧腰腹部出现蓝棕色斑，血压75／55mmHg，脉搏110次/分。对诊断困难者应进一步采取
A. 剖腹探查
B. ERCP检查
C. 抗感染治疗下严密观察
D. 抗休克治疗
E. 腹腔穿刺

正确答案：E。腹腔穿刺

解析：患者为中年男性，酗酒后出现中上腹疼痛（过量饮酒是急性胰腺炎的常见病因之一），放射至两侧腰部，恶心、呕吐，腹部有压痛、腹膜刺激征，两侧腰腹部出现蓝棕色斑（严重急性胰腺炎腰部、季肋部和下腹部皮肤可出现大片青紫色瘀斑），血压75/55mmHg（提示休克），脉搏110次/分（坏死性胰腺炎病人可有脉搏细速、血压下降，乃至休克）。据此，该患者可诊断急性胰腺炎。腹腔穿刺对少数急性胰腺炎诊断困难有确诊意义，若抽出血性渗出液，其淀粉酶值升高对诊断很有帮助（E对）。剖腹探查（A错）创伤太大，不作为首选。ERCP检查（B错）为医源性胰腺炎的常见诱因，不宜采取。抗感染治疗下严密观察（C错）容易延误病情。抗休克治疗（D错）不能用于诊断。